在我国开展人类辅助生殖技术，下列各项中符合卫生部制定的伦理原则的是
A. 一名供精者给5名以上的妇女受孕
B. 给单身妇女实施人工授精
C. 实施医学需要的性别选择
D. 对供精者实施商品化
E. 由医务人员做主对剩余的胚胎进行处理

正确答案：C。实施医学需要的性别选择